“非药品广告不得有涉及药品的宣传”出自于
A. 《中华人民共和国广告法》
B. 《中华人民共和国药品管理法》
C. 《中华人民共和国药品管理法实施条例》
D. 《药品经营质量管理规范》
E. 《处方药与非处方药分类管理办法（试行）》

正确答案：B。《中华人民共和国药品管理法》

解析：本题考查《中华人民共和国药品管理法》。“非药品广告不得有涉及药品的宣传”出自于《中华人民共和国药品管理法》（B对）。《中华人民共和国药品管理法》第八章药品价格和广告第九十条：药品广告的内容应当真实、合法，以国务院药品监督管理部门核准的药品说明书为准，不得含有虚假的内容。药品广告不得含有表示功效、安全性的断言或者保证；不得利用国家机关、科研单位、学术机构、行业协会或者专家、学者、医师、药师、患者等的名义或者形象作推荐、证明。非药品广告不得有涉及药品的宣传。